患者，女，39岁，蜂螫皮炎局部明显胀痛，疼痛，瘙痒，经拔刺、吸毒治疗后还应外涂药物是
A. 青黛散油
B. 紫金锭
C. 5%的碘酊
D. 50%的百部酊
E. 炉甘石洗剂

正确答案：B。紫金锭

解析：青黛散油适用于感染邪毒，水疱破后糜烂红肿者（A错）。紫金锭适用于蜂螫皮炎拔去毒刺后（B对）。5%的碘酒适用于松毛虫、桑毛虫皮炎黏去毛刺后（C错）。50%百部酊适用于生于毛发处（D错）。炉甘石洗剂适用于急性瘙痒性皮肤病（E错）。